患者，女，56岁，身高156cm，体重61kg。空血糖7.8mmol/L，餐后血糖11.2mmol/L，糖化血红蛋白6.7%。按上述方案治疗3个月后，查空腹血糖7.5mmol/L，餐后血糖12.2mmol/L，糖化血红蛋白7.0%。该患者经常出差，进食不规律，希望选择每日使用一次的降糖药。宜选用的药物是
A. 瑞格列奈片
B. 二甲双胍片
C. 格列美脲片
D. 阿卡波糖片
E. 预混人胰岛素30R注射液

正确答案：C。格列美脲片

解析：本题考查格列美脲。经常出差，进食不规律的患者选择每日1次用药的格列美脲（C对）更为方便。瑞格列奈片（A错）使用次数为每日1～3次，依从性没有格列美脲好，不宜选用。二甲双胍片（B错）使用次数为每日1～3次，依从性没有格列美脲好，不宜选用。阿卡波糖片（D错）使用次数为每日3次，依从性没有格列美脲好，不宜选用。预混人胰岛素30R注射液（E错）个体化给药，注射后三十分钟内必须进食，而患者经常出差，进食不规律，不宜选用。